对于舌侧倾斜较明显的下磨牙，全冠的舌侧龈边缘最好为
A. 刃状
B. 凹状
C. 90°肩台
D. 135°肩台
E. 带斜面的肩台

正确答案：A。刃状

解析：本题考查修复体龈边缘外形的选择应用。全冠牙体预备要求去除倒凹，形成良好就位道、抗力形、固位形。向舌侧明显倾斜的基牙为形成良好就位道，恢复正常外形，本身比正常的牙齿的磨除量多，下磨牙舌侧对美观要求不大，故采用刃状边缘（A对）即可，既符合生物学和生物力学原则，又能保证磨除的牙体组织量最少，增加牙体组织抗力。凹状（B错）、90°肩台（C错）、135°肩台（D错）、带斜面的肩台（E错）制备肩台时需磨除的牙体组织量均比刃状边缘多，对于此种类型的牙齿舌侧是没有必要的。